可引起视网膜变性的药物
A. 环孢素
B. 羟氯喹
C. 柳氮磺吡啶
D. 甲氨蝶呤
E. 来氟米特

正确答案：B。羟氯喹

解析：本题考查药物不良反应。可引起视网膜变性的药物是羟氯喹（B对）。羟氯喹有蓄积作用，易沉淀于视网膜的色素上皮细胞，引起视网膜变性而致失明，服药半年左右应检查眼底。另外，用药前、后应查心电图，有窦房结功能不全、心率缓慢、传导阻滞等心脏病患者应禁用。其他不良反应有头晕、头痛、皮疹、瘙痒和耳鸣等。环孢素（A错）主要不良反应有高血压、肝肾毒性、神经系统损害、继发性感染、肿瘤以及胃肠道反应、齿龈增生、多毛等。柳氮磺吡啶（C错）主要不良反应有恶心、呕吐、厌食、消化不良、腹痛、腹泻、皮疹、氨基转移酶增高和可逆性精子减少，偶有白细胞、血小板减少，对磺胺类过敏者禁用。甲氨蝶呤（D错）常见的不良反应有恶心、口炎、腹泻、脱发、皮疹，少数出现骨髓抑制、听力损害和肺间质病变，也可引起流产、畸胎和影响生育力。服药期间应适当补充叶酸，定期监测血常规和肝功能。来氟米特（E错）主要不良反应有腹泻、瘙痒、高血压、肝酶升高、皮疹、脱发和一过性白细胞计数下降等。因有致畸作用，故孕妇禁服。